下列有关肺心病和心力衰竭的说法哪项是错误的
A. 国内研究表明，肺心病者肺动脉楔压均超过正常范围
B. 以右心衰为主
C. 少数患者也可见左心衰
D. 反复肺部感染，细菌毒素对心肌的毒性作用可促进心衰
E. 心肌缺氧，乳酸堆积，高能磷酸键合成降低，使心肌功能受损

正确答案：A。国内研究表明，肺心病者肺动脉楔压均超过正常范围

解析：有关肺心病和心力衰竭的说法错误的是肺心病者肺动脉楔压均超过正常范围（A错，为本题正确答案），当处于代偿期时肺动脉压可无明显升高。肺心病是指由支气管－肺组织、胸廓或肺血管病变致肺血管阻力增加，产生肺动脉高压，继而右心室结构或（和）功能改变的疾病，以右心衰为主（B对），少数情况下如缺氧、高碳酸血症、酸中毒等，导致左心负荷增加，导致左心衰（C对）。低氧血症和呼吸道反复感染时的细菌毒素可直接损害心肌（D对），进而促进心衰。严重的缺氧和CO₂潴留可直接抑制心血管中枢，造成心脏活动抑制和血管扩张、血压下降、心律失常等严重后果（E对）。